根据执业药师资格制度现行规定，执业药师注册必须具备的条件包括
A. 获得《国家执业药师证书》
B. 遵纪守法，遵守职业道德
C. 身体健康，能坚持在执业药师岗位上工作
D. 有二年以上的药学实践经验
E. 所在单位考核同意

正确答案：A、B、C、E。获得《国家执业药师证书》；遵纪守法，遵守职业道德；身体健康，能坚持在执业药师岗位上工作；所在单位考核同意

解析：本题考查的是执业药师注册条件。根据执业药师资格制度现行规定，执业药师注册必须具备的条件包括获得《国家执业药师证书》（A对）；遵纪守法，遵守职业道德（B对）；身体健康，能坚持在执业药师岗位上工作（C对）；所在单位考核同意（E对）。执业药师注册条件：申请注册的执业药师，必须具备以下条件：①取得《执业药师职业资格证书》；②遵纪守法，遵守执业药师职业道德，无不良信息记录；③身体健康，能坚持在执业药师岗位工作；④经执业单位考核同意。有下列情形之一的申请注册人员，不予注册：①不具备完全民事行为能力的；②因受刑事处罚，自刑罚执行完毕之日到申请注册之日不满2年的；③受过取消执业药师执业资格处分不满2年的；④国家规定不宜从事执业药师业务的其他情形的（主要包括：甲、乙类传染病传染期，精神病发病期等健康状况不适宜或者不能胜任执业药师业务工作的）。